属于短效胰岛素或短效胰岛素类似物的是
A. 甘精胰岛素
B. 地特胰岛素
C. 低精蛋白锌胰岛素
D. 普通胰岛素
E. 精蛋白锌胰岛素

正确答案：D。普通胰岛素

解析：本题考查胰岛素的分类。普通胰岛素（D对）属于短效胰岛素。甘精胰岛素（A错）、地特胰岛素（B错）均为超长效胰岛素。低精蛋白锌胰岛素（C错）为中效胰岛素。精蛋白锌胰岛素（E错）为长效胰岛素